小儿致病性大肠杆菌肠炎病程约
A. 3～8天
B. 1～2周
C. 1～3天
D. 2～11天
E. 2个月

正确答案：B。1～2周